男性，52岁。1个月前发现左下后牙龈有小包，有时口腔内觉有咸水。曾有过左侧后牙夜痛，无其他不适。检查见左下第一前磨牙牙颈部楔状缺损，探硬，轻酸感；左下第二前磨牙牙颈部龋洞深，探无感觉，牙髓无活力，叩诊异常感；左下第一磨牙近中根尖部龈瘘，叩痛（-），牙髓活力正常。对龈瘘管可能做的处理如下，除外
A. 瘘管上药
B. 瘘管切除
C. 根尖手术
D. 治疗后搔刮
E. 治疗后观察

正确答案：B。瘘管切除

解析：龈瘘管是慢性牙槽脓肿的排脓道，慢性牙槽脓肿疾病治愈了，龈瘘自然消失。在行根管治疗的同时，可做瘘管上药；龈瘘消失缓慢，治疗后可做搔刮；根管治疗疗效不好，还可行根尖手术。因此，根管治疗疗效好，瘘管切除不需要；根管治疗疗效不好，瘘管切除没有作用。掌握“慢性根尖周炎”知识点。